位于枕叶与小脑之间的是
A. 蛛网膜
B. 软脑膜
C. 小脑幕
D. 硬脑膜
E. 窦汇

正确答案：C。小脑幕

解析：枕叶是大脑半球的分叶，而分隔大脑与小脑的是小脑幕，所以小脑幕（C对）位于枕叶与小脑之间。